患儿，10岁。哮喘缓解后，证见咳嗽痰多，食少脘痞，大便不实，倦怠乏力，舌苔少，色淡。治疗应首选
A. 苏葶丸
B. 三子养亲汤
C. 玉屏风散
D. 六君子汤
E. 金匮肾气丸

正确答案：D。六君子汤

解析：哮喘是一种反复发作的哮鸣气喘疾病，患儿脾虚不能化生气血，则化源不足，故倦怠乏力，中气衰馁，健运无权，食物不化精微，故食少脘痞，大便不实，脾湿不运，反为痰浊上泛，故咳嗽痰多（D对）。苏葶丸适于热性哮喘（A错）。三子养亲汤具有温肺化痰，降气消食之功效，主治痰壅气逆食滞证（B错）。玉屏风散适于肺气虚弱的哮喘缓解期（C错）。金匮肾气丸适于肾虚不纳的哮喘缓解期（E错）